样本是总体的
A. 有价值的部分
B. 有意义的部分
C. 有代表性的部分
D. 任意一部分
E. 典型部分

正确答案：C。有代表性的部分

解析：样本是根据随机化的原则从总体中抽出的有代表性的观察单位组成的子集，样本的指标用拉丁字母表示。掌握“统计基本概念和步骤”知识点。